为了延长局麻药的局麻作用和减少不良反应，可加用
A. 肾上腺素
B. 异丙肾上腺素
C. 多巴胺
D. 去甲肾上腺素
E. 麻黄碱

正确答案：A。肾上腺素

解析：肾上腺素加入局麻药注射液中，可延缓局麻药的吸收，延长局麻药的麻醉时间。掌握“肾上腺素”知识点。